依照《中华人民共和国药品管理法实施条例》，进口单位向海关办理报关验放手续
A. 应取得《进口药品注册证》
B. 应取得《医药产品注册证》
C. 取得《进口准许证》
D. 应取得《药品经营许可证》
E. 应取得《进口药品通关单》

正确答案：E。应取得《进口药品通关单》

解析：本题考查药品进口管理。依照《中华人民共和国药品管理法实施条例》，进口单位向海关办理报关验放手续应取得《进口药品通关单》（E对）。《中华人民共和国药品管理法实施条例》第五章药品管理第三十七条：进口药品到岸后，进口单位应当持《进口药品注册证》（A错）或者《医药产品注册证》（B错）以及产地证明原件、购货合同副本、装箱单、运单、货运发票、出厂检验报告书、说明书等材料，向口岸所在地药品监督管理部门备案。口岸所在地药品监督管理部门经审查，提交的材料符合要求的，发给《进口药品通关单》。进口单位凭《进口药品通关单》向海关办理报关验放手续。口岸所在地药品监督管理部门应当通知药品检验机构对进口药品逐批进行抽查检验；但是，有《药品管理法》第四十一条规定情形的除外。